大量输注葡萄糖和胰岛素时容易发生的电解质紊乱是
A. 低钾血症
B. 高钾血症
C. 高钠血症
D. 低钙血症
E. 低钠血症

正确答案：A。低钾血症

解析：大量输注葡萄糖和胰岛素时（钾向组织内转移）容易发生的电解质紊乱是低钾血症（A对）。